环境健康影响评价是对
A. 将来健康影响的评价
B. 目前健康影响的评价
C. 过去健康影响的评价
D. 目前和将来健康影响的评价
E. 过去和目前健康影响的评价

正确答案：A。将来健康影响的评价

解析：本题考查环境健康影响评价。环境健康影响评价是预测、分析和评估由规划和建设项目实施后可能造成的环境质最变化而带来的人群健康影响及其安全性。它是对将来健康影响的评价（A对BCDE错）。